肝阳偏亢，肝阳上扰，头痛，眩晕，失眠者，治疗应选用
A. 羚角钩藤汤
B. 天麻钩藤饮
C. 地黄饮子
D. 大定风珠
E. 镇肝熄风汤

正确答案：B。天麻钩藤饮

解析：肝阳偏亢，肝阳上扰为基本病机，故当以平肝息风为主；肝阳偏亢，风阳上扰，故头痛、眩晕；肝阳有余，化热扰心，故心神不安、失眠，故还当予以清热安神，补益肝肾，宜选天麻钩藤饮（B对）--方中天麻、钩藤平肝熄风，为君药。石决明咸寒质重，功能平肝潜阳，并能除热明目，与君药合用，加强平肝熄风之力；川牛膝引血下行，并能活血利水，共为臣药。杜仲、寄生补益肝肾以治本；栀子、黄芩清肝降火，以折其亢阳；益母草合川牛膝活血利水，有利于平降肝阳；夜交藤、朱茯神宁心安神，均为佐药。羚角钩藤汤功用为凉肝息风，增液舒筋，主治肝热生风证（A错）。地黄饮子功用为滋肾阴、补肾阳、开窍化痰，主治下元虚衰，痰浊上泛之喑痱证（C错）。大定风珠功用为滋阴息风，主治阴虚风动证（D错）。镇肝息风汤功用为镇肝息风，滋阴潜阳，主治类中风（E错）。